治疗霉菌性阴道炎，局部用药应首选
A. 制霉菌素加二妙虎参煎
B. 克林霉素加塌痒方
C. 甲硝唑加二妙虎参煎
D. 诺氟沙星加苦参合剂
E. 氯霉素加柴马洗剂

正确答案：A。制霉菌素加二妙虎参煎

解析：霉菌性阴道炎首选药物为制霉菌素胶囊50U，或制霉菌素膏涂于阴道壁和外阴部，早晚各1次，10-14天为1疗程（A对）。或局部使用克霉唑栓（B错）。甲硝唑用于抗厌氧菌治疗（C错），诺氟沙星（D错）、氯霉素（E错）针对细菌治疗效果佳。